36周男婴，出生体重1.5Kg，生后3天体温不升，需要暖箱，该暖箱温度应是
A. 31℃
B. 32℃
C. 33℃
D. 34℃
E. 35℃

正确答案：D。34℃

解析：新生儿（从脐带结扎到生后28天内的婴儿）体温调节中枢功能尚不完善，皮下脂肪薄，体表面积相对较大，皮肤表皮角化层差，易散热，且生后环境温度显著低于宫内温度，散热增加，如不及时保温，可发生低体温、低氧血症、低血糖和代谢性酸中毒或寒冷损伤。其中中性温度是指机体维持体温正常所需的代谢率和耗氧量最低时的环境温度。出生体重、生后日龄不同，中性温度不不同。由表7-3可知，出生体重为1.5Kg的新生儿生后3天体温不升，需要的暖箱温度即中性温度为34℃（D对）。